男，46岁。患汽车恐惧症，不敢独自在马路上走原因是怕车流，担心这些车辆要揸伤自己，治疗医师决定陪伴他站在马路边面对飞驰的汽车。该种治疗方法属于
A. 厌恶疗法
B. 暗示疗法
C. 系统脱敏疗法
D. 自我劝导疗法
E. 冲击疗法

正确答案：C。系统脱敏疗法

解析：该患者应诊断为特定恐惧症，是对某一特定物体或高度特定的情境强烈的、不合理的害怕或厌恶，应首选系统脱敏疗法。治疗师陪伴患者面对他所恐惧的汽车，诱导求治者缓慢地暴露出导致神经症焦虑、恐惧的情境，并通过心理的放松状态来对抗这种焦虑情绪，从而达到消除焦虑或恐惧的目的，这就是系统脱敏疗法（C对）。厌恶疗法是一种通过轻微的惩罚来消除适应不良行为的治疗方法。当某种适应不良行为即将出现或正在出现时，当即给予一定的痛苦刺激，如轻微的电击、针刺或催吐剂，使其产生厌恶的主观体验。经过反复实施，适应不良行为和厌恶体验就建立了一定的条件联系，以后当欲实施一定行为时，便立刻产生了厌恶体验（A错）。暗示疗法是指治疗时有意识的使用暗示去影响或改变个体的行为，以消除或减轻疾病症状的方法（B错）。冲击疗法是让病人一下子面对最高等级惧怕的 情况，甚至过分地与惧怕的情况接触。由于惧怕刺激的“泛滥性”的来临，个体面对过分的惧怕刺激，恐怖反应可能会逐渐减轻，甚至最终消失（E错）。